肛裂的主要临床表现是
A. 流脓
B. 周期性疼痛
C. 脓血便
D. 便血
E. 便秘

正确答案：B。周期性疼痛

解析：疼痛是肛裂的最主要症状，疼痛的程度和持续的时间预示着肛裂的轻重。一次典型的肛裂疼痛周期是：疼痛-缓解-高峰-缓解-再疼痛。排便时粪便刺激溃疡面的神经末梢，造成便后严重的烧灼样或刀割样疼痛，可放射到臀部、会阴部、骶尾部或大腿内侧，称为排便时疼痛。便后数分钟疼痛缓解，此期称疼痛间歇期。之后因内括约肌痉挛，产生剧痛，持续数分钟或数小时，此时患者会坐立不安，难以承受，直至括约肌疲劳后，肌肉松弛，疼痛逐渐缓解。待到再次排便，疼痛再次发生（B对）。流脓多有细菌感染、炎症化脓引起，肛裂一般无此类表现（A错）。脓血便指大便中混有脓状物质及血液。原因是肠道有炎症或受外界刺激，如细菌性痢疾，炎症性肠病等均可以造成肠道的黏膜受损，出现脓血便。治疗原则是针对病因对症治疗（C错）。内痔以无痛性便血为主要症状，血液与大便不相混，多在排便时滴血或射血。出血呈间歇性，每因饮酒、过劳、便秘或腹泻时使便血复发和加重（D错）。便秘除了受年龄、生活习惯等因素影响外，一些肠道的病变，如炎症性肠病、肿瘤、疝、直肠脱垂等，此类病变导会致功能性出口梗阻引起排便障碍，引起便秘（E错）。